腹股沟疝查体时，压迫腹股沟管深环的部位是
A. 精索内前方2cm
B. 髂前上棘与耻骨结节连线中点
C. 腹股沟韧带中点上方2cm
D. 肿块隆起最明显处
E. 耻骨结节外侧2cm

正确答案：C。腹股沟韧带中点上方2cm

解析：腹股沟管位于腹前外侧壁的下部、腹股沟韧带内侧半的上方，由外上斜向内下，男性的精索或女性的子宫圆韧带由此通过。腹股沟管有内、外两口，其中内口即腹股沟管深（腹）环，位于腹股沟中点上方2cm处。因此腹股沟疝查体时，压迫腹股沟管深环的部位是腹股沟韧带中点上方2cm（C对）。